在煤矿开采过程中，产生的含有游离二氧化硅含量低于（）的煤尘称为单纯性煤尘。
A. 0.05
B. 0.1
C. 0.02
D. 0.01
E. 0.15

正确答案：A。0.05

解析：本题考查单纯性煤肺的概念。煤尘中游离SiO₂含量在5%（A对BCDE错）以下的的煤尘，称为单纯性煤尘，长期吸入单纯性煤尘的采煤工作面工人容易患煤肺。